病人患胆管癌，术中术者用手指钝性剥离胆总管而撕破静脉，导致病员急性大出血，慌乱中术者用钳夹止血，造成静脉完全离断，虽经吻合术，病员终因急性肝功能衰竭而死亡，产生的后果属于
A. 医疗意外
B. 医疗差错
C. 病情重而发生的难以避免的死亡
D. 医疗事故
E. 手术难以避免的并发症

正确答案：D。医疗事故

解析：题干强调“慌乱”，属于医师的过失行为，术后造成的患者死亡属于医疗事故（D对）。医疗意外是指医务人员在从事诊疗或护理工作过程中，由于患者的病情或患者体质的特殊性而发生难以预料和防范的患者死亡、残疾或者功能障碍等不良后果的行为。医务人员的行为与损害结果间不具有直接的因果关系（A错）。医疗差错是指在诊疗护理过程中，医务人员确有过失，但经及时纠正未给病人造成严重后果或未造成任何后果的医疗纠纷，本题中患者术后死亡，属于严重后果（B错）。患者因医师过失行为死亡，并非个人病情客观原因造成的（CE错）。